痛痹的临床特征是
A. 关节酸痛，游走不定
B. 关节疼痛，红肿灼热
C. 疼痛剧烈，痛有定处
D. 酸痛重者，肌肤不仁
E. 屈伸不利，心悸气短

正确答案：C。疼痛剧烈，痛有定处

解析：痛痹的发生，多缘于风寒湿邪闭阻经络，而以寒邪偏盛，寒为阴邪，其性凝滞，故痛有定处，疼痛剧烈，痛有定处。得热则气血较为流畅，故其痛减，得寒则血益凝涩，故痛更甚，寒属阴邪，故局部不红，触之不热。（C对）。关节酸痛，游走不定为行痹，属风邪盛（A错）。关节疼痛，红肿灼热为热痹的临床特征（B错）。酸痛重者，肌肤不仁，关节酸痛、重着、漫肿者为着痹，属湿邪盛（D错）。屈伸不利，心悸气短为脏痹、心痹的特征（E错）。